高温巴氏消毒效果好，但不能杀灭
A. 繁殖型微生物
B. 大肠杆菌
C. 芽孢型微生物
D. 沙门菌
E. 酵母菌

正确答案：C。芽孢型微生物